咬肌间隙感染如未及时切开引流，最常引起的并发症是
A. 败血症
B. 脓毒血症
C. 下颌骨中央性骨髓炎
D. 颈间隙感染
E. 下颌骨边缘性骨髓炎

正确答案：E。下颌骨边缘性骨髓炎

解析：本题考查咬肌间隙感染未及时切开引流而引起的并发症。由于咬肌肥厚坚实，脓液难以自行破溃，若咬肌间隙感染未及时切开引流，易形成下颌支的边缘性骨髓炎（E对）。败血症（A错）是指细菌进入血循环，并在其中生长繁殖，产生毒素而引起的全身性严重感染。脓毒症（B错），即脓毒血症，化脓性病原菌侵入血流并在其中大量的繁殖，并随血流向全身扩散，在组织器官引起的新的多发性化脓性病灶。两者在咬肌间隙感染中不常见。下颌骨中央性骨髓炎（C错）常由急性根尖周炎和根尖周脓肿发展而来。咬肌间隙未与颈间隙直接相通，不会首先造成颈部间隙的感染（D错）。